可摘局部义齿恢复功能、避免组织损伤的基础是
A. 义齿的坚固耐用
B. 义齿的摘戴方便
C. 义齿的外形美观
D. 义齿的固位和稳定
E. 义齿的保健作用

正确答案：D。义齿的固位和稳定

解析：本题考查局部义齿的设计。义齿只有在固位和稳定（D对）良好的基础上才能发挥最大功能，避免组织损伤。